治疗肺痈的要药是
A. 野菊花
B. 金银花
C. 蒲公英
D. 鱼腥草
E. 败酱草

正确答案：D。鱼腥草

解析：鱼腥草辛、微寒，归肺经，以清解肺热见长，又具消痈排脓之效，故为治肺痈要药（D对）。野菊花苦辛、微寒，归肝、心经，清热解毒功效专，善治痈肿、疔毒、咽喉肿痛、风火赤眼、皮肤瘙痒等病症（A错）。金银花甘寒，归肺、心、胃，清热解毒，消散痈肿力强，为治热毒疮痈之要药，适用于各种热毒壅盛之外疡内痈，喉痹，丹毒（B错）。蒲公英苦寒，归肝、胃经，善清热解毒，消痈散结，主治内外热毒疮痈诸证，兼能通乳，故为治乳痈要药（C错）。败酱草辛苦、微寒，归胃、大肠、肝经，既能清热解毒，又可消痈排脓，且能活血止痛，为治肠痈腹痛之要药（E错）。